一患者下颌左5678右678缺失，左下4不松动、无龋，牙槽嵴丰满。铸造支架式义齿左下4右下5远中（牙合）支托、三臂卡固位体，舌杆大连接体。义齿戴用1周后，主诉基托压痛、基牙咬合痛。口腔内检查发现：舌系带根部小溃疡，左侧下颌隆凸处黏膜红肿，左下4叩痛（+），义齿各部分密合，咬合不高。舌系带根部溃疡的原因是
A. 义齿前后翘动
B. 义齿摘戴困难
C. 义齿下沉
D. 舌杆位置过低
E. 舌杆未缓冲

正确答案：D。舌杆位置过低

解析：本题考查义齿戴入后可能出现的问题。铸造支架式义齿采用舌杆大连接体，当舌杆位置过低（D对），妨碍舌系带运动时，会导致舌系带根部溃疡的发生。义齿前后翘动（A错）会导致义齿不稳定，咀嚼效率降低，一般不会造成舌部溃疡。义齿摘戴困难（B错）会妨碍义齿的使用，降低患者的使用信心。义齿下沉（C错）、舌杆未缓冲（E对）可造成舌杆压迫软组织，口底及舌系带均可发生溃疡，但不是舌系带根部溃疡。